男性，50岁，左腮腺区无痛性肿块数年。镜下见肿瘤由上皮组织和淋巴样组织组成，上皮成分形成不规则囊腔，细胞排列成假复层，间质中淋巴细胞密集，并形成淋巴滤泡。病理诊断为
A. 多形性腺瘤
B. 肌上皮瘤
C. 基底细胞腺瘤
D. 嗜酸性腺瘤
E. 沃辛瘤（腺淋巴瘤）

正确答案：E。沃辛瘤（腺淋巴瘤）

解析：沃辛瘤（腺淋巴瘤）由腺上皮和淋巴成分构成。肿瘤形成较多的囊样腔隙，内有假复层排列的腺上皮衬覆，间质中有大量的淋巴细胞并形成淋巴滤泡。掌握“沃辛瘤及嗜酸性腺瘤”知识点。